肉芽组织主要是由下列哪种细胞组成
A. 成纤维细胞，新生毛细血管和炎性细胞
B. 成纤维细胞，新生毛细血管和巨噬细胞
C. 纤维细胞，新生毛细血管和炎性细胞
D. 炎性细胞和成纤维细胞
E. 新生毛细血管和巨噬细胞

正确答案：A。成纤维细胞，新生毛细血管和炎性细胞

解析：肉芽组织主要是由成纤维细胞，新生毛细血管和炎性细胞（A对）组成的。虽然巨噬细胞是参与构成肉芽组织的最主要的炎性细胞，但除它之外还有中性粒细胞、淋巴细胞等其他炎性细胞共同参与，故不选B选项。纤维细胞（C错）和成纤维细胞是处于不同功能状态的同一种细胞，参与肉芽组织形成的是功能活跃的成纤维细胞。